属于苯烷胺类选择性钙离子通道阻滞药是
A. 硝苯地平
B. 维拉帕米
C. 普尼拉明
D. 哌克昔林
E. 氟桂利嗪

正确答案：B。维拉帕米